对小儿感冒病证特点的论述，错误的是
A. 夹痰
B. 夹瘀
C. 夹食
D. 热证实证多
E. 寒证虚证少

正确答案：B。夹瘀

解析：本题考查的是小儿感冒的症状特点。对小儿感冒病证特点的论述，错误的是夹瘀（B错，为本题正确答案）。小儿感冒的病情以热证、实证为多（D对），寒证、虚证少（E对），夹痰（A对）、夹食（C对）、夹惊等兼夹证为常见。